与精神意识思维活动关系最密切的是
A. 心主血脉功能
B. 肝主疏泄的功能
C. 肺主治节的功能
D. 脾主运化的功能
E. 肾主藏精的功能

正确答案：A。心主血脉功能

解析：心为藏神之脏，故情志所伤，首伤心脾，次及相应脏腑，导致脏腑气机失乱。血是神志活动的物质基础之一，《灵枢·营卫生会》说“血者，神气也”，而心藏神，能驭气以调控心血的运行。所以说心主血脉与精神意识思维活动关系最密切（A对）。肝能调畅情志（B错）。